与内源性抗原提呈密切相关的分子是
A. MHCⅠ类分子
B. MHCⅡ类分子
C. FcγR
D. mlg
E. C3bR

正确答案：A。MHCⅠ类分子